亚慢性毒性试验的主要目的是
A. 探讨阈剂量及最大无作用剂量
B. 观察中毒症状
C. 探讨剂量反应关系
D. 预测有无潜在性危害
E. 以上都是

正确答案：A。探讨阈剂量及最大无作用剂量